阿托品的不良反应为
A. 瞳孔轻度扩大、视近物清楚
B. 肠蠕动增加、腹泻
C. 心率加快、血压升高
D. 汗液、唾液分泌增加
E. 中枢兴奋、呼吸加快

正确答案：E。中枢兴奋、呼吸加快